应当具有高中以上文化程度的是
A. 质量管理工作人员
B. 养护工作人员
C. 药品采购工作人员
D. 药品销售人员

正确答案：D。药品销售人员

解析：本题考查药品零售企业经营和质量管理人员的资质要求。药品采购工作人员（D对）中从事药品销售、储存等工作的人员应当具有高中以上文化程度。